下列关于颞下颌关节复发性脱位的叙述中，正确的是
A. 临床表现与急性前脱位相同
B. X线片可见髁突脱位于关节结节前上方
C. 复发性脱位可为单侧或双侧
D. 在大开口时，患者突然感到下颌骨不能自如运动，前牙不能闭合
E. 以上均正确

正确答案：E。以上均正确

解析：复发性脱位可为单侧或双侧。在大开口时，患者突然感到下颌骨不能自如运动，前牙不能闭合，其临床表现与急性前脱位相同。根据病史和临床可作出诊断。X线片可见髁突脱位于关节结节前上方。掌握“颞下颌关节脱位”知识点。